易受光线影响而变质的药品是
A. 维生素B₂片
B. 胰酶片
C. 胰岛素
D. 右旋糖酐40注射液
E. 甘露醇注射液

正确答案：A。维生素B₂片

解析：本题考查药品的贮存。维生素B₂片（A对）易受光线影响而变质，需避光保存。胰酶片（B错）易受湿度影响而变质，不能受潮。胰岛素（C错）易受温度影响而变质，需要在冷处贮存。右旋糖酐40注射液（D错）应在25℃以下保存。甘露醇（E错）不易冷冻，需遮光，密闭保存。